患儿，1岁。发病于7月份，发热1个月未退，朝盛暮衰，口渴多饮，面色苍白，小便澄清频数，下肢清冷。其治法是
A. 清肺热，温脾阳
B. 养肺阴，温肾阳
C. 补脾气，养胃阴
D. 养胃阴，温脾阳
E. 清心火，温肾阳

正确答案：E。清心火，温肾阳

解析：患儿夏季发热1月未退，口渴多饮，面色苍白，小便澄清频数，当属夏季热，疾病日久不退，脾肾亏虚，命门火衰，则见小便清长无度，下肢清冷，真阴不足，津亏不能上济于心，暑热熏蒸于上，则见口渴多饮，病机属上盛下虚，当治以清心火，温肾阳（E对）。患儿无肺热、脾阳亏虚之象（A错）。若肺阴不足，应可见潮热、盗汗，咳嗽，痰黏稠等，患儿无肺阴亏虚之象（B错）。若脾气亏虚，胃阴不足，患儿应有纳呆，便溏，四肢无力，嘈杂似饥，饥不欲食等表现（C错）。若有脾阳不足，应可见纳呆，便溏，腹胀腹痛，四肢不温等表现（D错）。